一患者入院后对医生抱怨自己没钱买药，病情加重后才住院治疗，子女对自己关心不足，医护人员更加关心其他患者对自己关心不够，要求更换医生，对该患者的行为，医生的正确做法是
A. 批评教育
B. 理解尊重
C. 耐心倾听
D. 特殊照顾
E. 转诊

正确答案：B。理解尊重

解析：疾病对病人的生活和工作影响很大，病人常常很难适应新的社会角色，在患病情况下，部分病人可能会出现情绪问题，此时我们可以选择支持疗法，通过从病人的角度充分理解病人的痛苦和对疾病的认识，尊重和关心病人(B对）｡